有关RNA分类、分布及结构的叙述错误的是
A. 主要有mRNA、tRNA和rRNA三类
B. tRNA分子量比mRNA和rRNA小
C. 胞质中只有mRNA
D. rRNA可与蛋白质结合
E. RNA并不全是单链结构

正确答案：C。胞质中只有mRNA